依照《处方药与非处方药流通管理暂行规定》，普通商业企业零售乙类非处方药
A. 必须配备从业药师
B. 必须取得准销标志
C. 必须配备执业药师
D. 应设立专门货架或专柜
E. 不得附赠药品销售

正确答案：B、D、E。必须取得准销标志；应设立专门货架或专柜；不得附赠药品销售

解析：本题考查普通商业企业的药品零售。依照《处方药与非处方药流通管理暂行规定》，普通商业企业零售乙类非处方药必须取得准销标志（B对）、应设立专门货架或专柜（D对）、不得附赠药品销售（E对）。《处方药与非处方药流通管理暂行规定》第五章普通商业企业零售第十九条：在药品零售网点数量不足、布局不合理的地区，普通商业企业可以销售乙类非处方药，但必须经过当地地市级以上药品监督管理部门审查、批准、登记，符合条件的颁发乙类非处方药准销标志。具体实施办法由省级药品监督管理部门制定。根据便民利民的原则，销售乙类非处方药的普通商业企业也应合理布局。鼓励并优先批准具有《药品经营企业许可证》的零售药店与普通商业企业合作在普通商业企业销售乙类非处方药。第二十条：普通商业企业不得销售处方药和甲类非处方药，不得采用有奖销售、附赠药品或礼品销售等销售方式销售乙类非处方药，暂不允许采用网上销售方式销售乙类非处方药。第二十一条：普通商业企业的乙类非处方药销售人员及有关管理人员必须经过当地地市级以上药品监督管理部门适当的药品管理法律、法规和专业知识培训、考核并持证上岗（AC错）。第二十二条：普通商业企业销售乙类非处方药时，应设立专门货架或专柜，并按法律法规的规定摆放药品。